因地质地理原因，使某地区土壤饮水中微量元素含量过多或过少，导致该地区居民发生一种特殊性疾病，该病称
A. 公害病
B. 生物地球化学性疾病
C. 慢性营养性缺乏病
D. 代谢障碍病
E. 自然疫源病

正确答案：B。生物地球化学性疾病

解析：本题考查生物地球化学性疾病。生物地球化学性疾病（B对ACDE错）是由于地壳表面化学元素分布的不均匀性，使某些地区的水和（或）土壤中某些元素过多或过少，当地居民通过饮水、食物等途径摄入这些元素过多或过少，而引起某些特异性疾病。